主血瘀证的面色有
A. 青色赤色
B. 青色黑色
C. 黄色黑色
D. 赤色黑色
E. 赤色白色

正确答案：B。青色黑色

解析：青色主寒证、气滞、血瘀、疼痛、惊风；黑色主肾虚、寒证、水饮、血瘀、疼痛；青色和黑色均主血瘀证（B对）。赤色主热证，亦可见于真寒假热之戴阳证（ADE错）。黄色主脾虚、湿证（C错）。白色主虚证、寒证、失血、夺气（E错）。